关于短效口服避孕药作用机制，不正确的是
A. 抑制排卵
B. 改变宫颈黏液性状
C. 影响精子获能
D. 抑制子宫内膜增殖变化
E. 使子宫内膜分泌不良

正确答案：C。影响精子获能

解析：短效口服避孕药的作用机制为1.抑制排卵（A对）2.改变宫颈黏液性状（B对）3.改变子宫内膜形态和功能（DE对），子宫内膜的正常生理变化，为胚胎着床创造必要条件，避孕药抑制子宫内膜增值变化，使子宫内膜与胚胎发育不同步，不适于受精卵着床4.改变输卵管的功能。影响精子获能（C错，为本题正确答案）为宫内节育器的铜离子作用，其具有使精子头尾分离的毒性作用。